根据心理学的理论和方法对人的心理品质及水平所作出的鉴定，称为
A. 心理评估
B. 心理测量
C. 心量治疗
D. 心理测验
E. 心理疏导

正确答案：A。心理评估